按照国际抗癌协会的TNM分期法，M1表示
A. 未发现原发肿瘤
B. 无法明确肿瘤体积
C. 未发现区域性淋巴结
D. 未发现远处转移
E. 表示有远处转移

正确答案：E。表示有远处转移

解析：乳腺癌的TNM分期（T：原发肿瘤，N：区域淋巴结，M：远处转移）中M1表示临床及影像学检查发现远处转移（E对），或组织学发现＞0.2mm的转移。T0：无原发肿瘤证据（A错）。Tx：无法判断肿瘤体积（B错）。N0：区域淋巴结无转移（C错）。M0：临床及影像学检查未见远处转移（D错）。